40岁以上妇女宜采取的避孕方法是
A. 避孕套
B. 宫内节育器
C. 自然避孕
D. 屏障避孕
E. 短效口服避孕药

正确答案：D。屏障避孕

解析：本题考查常用的避孕方法。40岁以上的妇女，卵巢功能开始逐渐衰退，但仍有可能排卵，需要继续避孕。此期应选择不影响内分泌功能的避孕措施，而以屏障避孕（D对ABCE错）为主，可以同时应用避孕药膏或避孕栓增加滑润度。